既息风止痉，又祛风湿、止痹痛的药是
A. 天麻
B. 罗布麻
C. 白僵蚕
D. 代赭石
E. 珍珠母

正确答案：A。天麻

解析：本题考查天麻的功效。既息风止痉，又祛风湿、止痹痛的药是天麻（A对）。天麻【功效】息风止痉，平抑肝阳，祛风通络。罗布麻叶（B错）【功效】平肝清热，降血压，利水。僵蚕（C错）【功效】息风止痉，祛风止痛，化痰散结。代赭石（D错）【功效】平肝潜阳，重镇降逆，凉血止血。珍珠母（E错）【功效】平肝潜阳，清肝明目，安神定惊，收湿敛疮。